邪热炽盛，煎灼津液，伤及营血，燔灼肝经，可以形成
A. 风气内动
B. 寒从中生
C. 湿浊内生
D. 津伤化燥
E. 火热内生

正确答案：A。风气内动

解析：邪热煎灼津液，伤及营血，燔灼肝经，筋脉失其柔顺之性是热极生风的原因（A对）。“邪热炽盛”与寒邪无关（B错），不涉及湿邪（C错），“煎灼津液，伤及营血,燔灼肝经”说明津伤程度重，但津伤化燥程度较轻，所以津伤化燥不符合题意（D错），而火热内生是由阳盛有余，或阴虚阳亢，或由于气血郁滞，或由于病邪郁结而产生的火热内扰，机能亢奋的病理状态，不是由邪热炽盛，煎灼津液，伤及营血，燔灼肝经形成的，所以火热内生不符合题意（E错）。